石决明来源于哪一科动物的贝壳
A. 珍珠贝科
B. 蚌科
C. 鲍科
D. 牡蛎科
E. 海龙科

正确答案：C。鲍科

解析：本题考查的是石决明的来源。石决明来源于鲍科（C对）的贝壳。石决明：【来源】为软体动物门鲍科动物杂色鲍（九孔鲍）、皱纹盘鲍、羊鲍、澳洲鲍、耳鲍或白鲍的贝壳。来源于珍珠贝科（A错）与蚌科（B错）的中药为珍珠。珍珠：【来源】为软体动物门珍珠贝科动物马氏珍珠贝、蚌科动物三角帆蚌或褶纹冠蚌等双壳类动物受刺激而形成的珍珠。来源于牡蛎科（D错）的中药为牡蛎等。牡蛎：【来源】为软体动物门牡蛎科动物长牡蛎、大连湾牡蛎或近江牡蛎的贝壳。来源于海龙科（E错）的中药为海马。海马：【来源】为脊索动物门鱼纲海龙科动物线纹海马、刺海马、大海马、三斑海马或小海马（海蛆）的干燥体。